苯主要以下列哪种途径进入人体
A. 经皮肤
B. 经消化道
C. 以蒸汽的形式经呼吸道
D. 主要经皮肤和呼吸道
E. 经呼吸道和消化道

正确答案：C。以蒸汽的形式经呼吸道